可抑制髓造血功能，导致轻度贫血的抗艾滋病药品是
A. 利托那韦
B. 尼莫地平
C. 利巴韦林
D. 齐多夫定
E. 长春新碱

正确答案：D。齐多夫定

解析：本题考查抗艾滋病药品的不良反应。齐多夫定（D对）的不良反应中，常见头痛、恶心、呕吐和肌痛等；部分患者（25%）出现骨髓抑制如白细胞减少、血小板减少和贫血等。利托那韦（A错）可诱发胰腺炎，导致血清酯酶升高。尼莫地平（B错）是二氢吡啶类钙通道阻滞剂，不属于抗艾滋病药品。利巴韦林（C错）是抗流感病毒药。长春新碱（E错）为抗肿瘤药。